肌酐肾清除率的概念可定义为肾脏在单位时间内
A. 完全清除掉相当于若干毫升血浆中肌酐的能力
B. 清除一定体液中肌酐的能力
C. 清除血浆中一定量肌酐的能力
D. 清除血浆中肌酐到终尿中的能力
E. 完全清除掉一定容积血液中肌酐的能力

正确答案：A。完全清除掉相当于若干毫升血浆中肌酐的能力